与龋病发病关系密切的菌斑是
A. 龈上菌斑
B. 山梨糖醇
C. 龈下菌斑
D. 木糖醇
E. 半乳糖

正确答案：A。龈上菌斑

解析：本题考查龋病的临床表现与分类。牙面菌斑的总称为牙菌斑，依其所在部位可分龈上菌斑和龈下菌斑。龈上菌斑（A对）位于龈缘上方，与龋病发病关系密切。